典型流脑脑脊液改变是
A. 白细胞减少，蛋白正常，糖含量正常
B. 白细胞增多，蛋白升高，糖含量明显降低
C. 白细胞增多，蛋白升高，糖含量轻度降低
D. 白细胞减少，蛋白升高，糖含量正常
E. 白细胞增多，蛋白降低，糖含量正常

正确答案：B。白细胞增多，蛋白升高，糖含量明显降低

解析：脑脊液检查是诊断流脑的重要方法。病初或休克型患者，脑脊液多无改变，应12～24 小时后复查。典型的脑膜炎期，压力增高，外观呈浑浊米汤样甚或脓样；白细胞数明显增高至1000×10⁶/L以上，以多核细胞为主；糖及氯化物明显减少，蛋白含量升高（B对）。